以下哪一组疾病，都应以第一级预防为重点
A. 地方病、传染病、职业病
B. 职业病、心脑血管疾病、传染病
C. 食物中毒、肿瘤、公害病
D. 地方病、肿瘤、职业病
E. 公害病、心脑血管疾病、传染病

正确答案：A。地方病、传染病、职业病

解析：第一级预防又称病因预防，是针对病因所采取的预防措施。以第一级预防为重点的疾病有以下几种情况：①综合性第一级预防有效的地方病：②病因明确尤其是认为因素造成的疾病，如职业因素所致疾病、医源性疾病：③可以通过预防接种提高人群免疫力的传染病（A对）。肿瘤以第一二级预防为主：心、脑血管疾病要兼顾第一二三级预防：食物中毒这样的难以察觉预料的疾病，只有施行第三级预防这一途径（BCDE错）。